营养性巨幼细胞性贫血的病因是
A. 缺乏VitB₁₂
B. 缺乏VitB₆
C. 缺乏VitB₁
D. 缺乏乙酸
E. 缺乏草酸

正确答案：A。缺乏VitB₁₂

解析：营养性巨幼细胞性贫血的病因是缺乏VitB12（A对）和（或）缺乏叶酸。缺乏VitB6（B错）引起的贫血多是小细胞低色素性贫血，缺乏VitB1（C错）引起的是脚气病。